下列各项，不属青皮主治病证的是
A. 胸胁胀痛
B. 乳房胀痛
C. 食积腹痛
D. 疝气疼痛
E. 呕吐呃逆

正确答案：E。呕吐呃逆

解析：该题考查青皮的主治病证。青皮的功效为疏肝破气，消积化滞。 青皮辛散温痛，苦泄下行而奏疏肝理气、散结止痛之功。尤宜于治疗肝郁气滞之胸胁胀痛、疝气疼痛、乳房肿痛。此外青皮有消积化滞之功，可治食积腹痛。青皮无降逆止呕之功效，不可治疗呕吐呃逆（ABCD错E对）。